善治乳痈肿痛的药物是
A. 龙胆草
B. 夏枯草
C. 鱼腥草
D. 芦根
E. 蒲公英

正确答案：E。蒲公英

解析：本题考查的是蒲公英的主治病证。善治乳痈肿痛的药物是蒲公英（E对）。蒲公英：【主治病证】（1）乳痈，痈肿疮毒，各种内痈。（2）咽喉肿痛，目赤肿痛，毒蛇咬伤。（3）湿热黄疸，热淋涩痛。龙胆草（A错）即龙胆。龙胆：【主治病证】（1）湿热下注之阴肿阴痒、带下、阴囊湿疹，湿热黄疸。（2）肝火上炎之头痛目赤、耳聋胁痛等。（3）高热抽搐，小儿急惊，带状疱疹。夏枯草（B错）：【主治病证】（1）肝阳或肝火上升之头目眩晕。（2）目赤肿痛，目珠夜痛。（3）痰火郁结之瘰疬、瘿瘤。鱼腥草（C错）：【主治病证】（1）肺痈咳吐脓血，肺热咳嗽痰稠。（2）热毒疮疡，湿热泻痢。（3）热淋涩痛。芦根（D错）：【主治病证】（1）热病烦渴，舌燥少津。（2）胃热呕哕。（3）肺热或外感风热咳嗽，肺痈吐脓。（4）小便短赤，热淋涩痛。